缺失
A. 染色体的非染色带无线状连接
B. 染色体的非染色带有线状连接
C. 光镜下不可见的DNA缺失
D. 远离原位的染色体断裂节段
E. 有染色质缺失的染色体

正确答案：E。有染色质缺失的染色体

解析：本题考查缺失。缺失是指有染色质缺失的染色体（E对ABCD错）。